静脉注射20%葡萄糖50ml，尿量明显增加。尿量增多的主要原因是
A. 肾小球滤过率增加
B. 血容量增加
C. 肾小管对水的通透性降低
D. 肾小管溶质浓度增加
E. 肾小管为Na⁺重吸收减少

正确答案：D。肾小管溶质浓度增加